通过伊蚊传播，感染机体后在毛细血管内皮细胞增殖，释放入血形成病毒血症的病原体是
A. 登革病毒
B. 乙型肝炎病毒
C. 埃博拉病毒
D. 汉坦病毒
E. 巨细胞病毒

正确答案：A。登革病毒